患儿，发热1天，腹泻6～7次，为黏液性脓血便，腹痛伴里急后重，病前吃过未洗的黄瓜，大便常规检查：黏液便，红、白细胞满视野，诊断为细菌性痢疾。其类型属于
A. 普通型
B. 轻型
C. 重型
D. 中毒型
E. 漫性型

正确答案：A。普通型

解析：该患儿已被明确诊断为细菌性痢疾。急性细菌性痢疾可分为普通型（典型）、轻型（非典型）、重型和中毒型（E错），其中，普通型的特点为起病急，有中度毒血症表现，畏寒，发热达39℃、乏力、食欲减退、恶心、呕吐、腹痛、腹泻、里急后重。该患儿发病前有食用过不洁食物史，急性起病，发病1天，腹痛伴里急后重，腹泻6～7次，为黏液性脓血便，大便常规检查：黏液便，红、白细胞满视野，此为细菌性痢疾的典型临床表现，故属于普通型（A对）。轻型（非典型）（B错）临床表现为全身中毒症状、腹痛、里急后重、左下腹压痛均不明显，可有低热、糊状或水样便，混有少量黏液，无脓血，一般腹泻次数每日10次以下，粪便镜检有红、白细胞，培养有痢疾杆菌生长。重型（C错）多见于年老体弱或营养不良的患者，有严重全身中毒症状及肠道症状，起病急、高热、恶心、呕吐，剧烈腹痛及腹部压痛，里急后重明显，脓血便，便次频繁，甚至失禁，病情进展快，明显失水，四肢发冷，极度衰竭，易发生休克。中毒型（D错）多见于2～7岁体质好的儿童，起病急骤，全身中毒症状明显，高热达40℃以上，患者精神萎靡、面色青灰、四肢厥冷、呼吸微弱、皮肤发花、反复惊厥、嗜睡、甚至昏迷，而肠道炎症反应极轻。慢性细菌性痢疾可分为慢性隐匿型、慢性迁延型和慢性型急性发作。